下面哪项不是咬肌的止点
A. 下颌骨的咬肌粗隆
B. 下颌骨喙突
C. 下颌骨外侧面上部
D. 下颌骨外侧面下半部
E. 下颌骨髁状突颈部

正确答案：E。下颌骨髁状突颈部

解析：本题考查咬肌。下颌骨髁状突颈部（E错，为本题的正确答案）不是咬肌的止点。翼外肌下头止于下颌髁突颈部。咬肌浅层止于下颌骨的咬肌粗隆（A对）和下颌支外侧面的下后部（D对），中层止于下颌支中部，深层止于下颌支上部（C对）和喙突（B对）。